某药物的生物半衰期是6.93h，表观分布容积是100L，该药物有较强的首过效应，其体内消除包括肝代谢和肾排泄，其中肾排泄占总消除的20%，静脉注射该药200mg的AUC是20㎍·h/ml，将其制备成片剂用于口服，给药100mg后的AUC为10㎍·h/ml。该药物片剂的绝对生物利用度是
A. 10%
B. 20%
C. 40%
D. 50%
E. 80%

正确答案：A。10%

解析：本题考查生物利用度。参比制剂：静脉注射（iv）该药200mg·h/ml。试验制剂（T）：片剂用于口服，给药1000mg·h/ml。（AUCT×XR）/（AUCR×XT）×100%代入数值可得（10×200）/（20×1000）×100%=10%（A对）。